闭经的病因病机，下列哪一项是错误的
A. 肾气未充，或肾精亏损，气血不足，血海不能满溢
B. 气虚血弱，冲任血少，血海空虚
C. 气滞血瘀，冲任受限
D. 痰湿阻滞，胞脉阻塞
E. 以上都不是

正确答案：E。以上都不是

解析：闭经的病因病机分虚实两类，虚者多因精血匮乏，冲任不充，血海空虚，无血可下；实者多为邪气阻隔，冲任瘀滞，脉道不通，经不得下。肾虚，肾气未充，可致肾经亏损而血少，肾气衰弱，冲任亏虚，血海不能满盈，则月经停闭（A对）。脾胃为气血生化之源，脾气虚弱，则气血亏虚，冲任血少，血海空虚，致使闭经（B对）。素性抑郁，或七情所伤，肝气郁结，久则气滞血瘀，冲任瘀阻，经血不得下行，导致闭经（C对）。素体肥胖，痰湿偏盛，或饮食劳倦，脾失健运，内生痰湿下注冲任，壅遏闭塞胞脉，经血不得下行，而致闭经（D对）（E错，为本题正确答案）。